衣原体引起的疾病中不包括
A. 衣原体肺炎
B. 沙眼
C. 泌尿生殖道感染
D. 斑疹伤寒
E. 鹦鹉热

正确答案：D。斑疹伤寒

解析：本题考查衣原体引起的疾病。斑疹伤寒（D错，为本题的正确答案）是由立克次体感染引起的。衣原体引起的疾病有衣原体肺炎（A对）、咽炎、沙眼（B对）、泌尿生殖道感染（C对）、鹦鹉热（E对）等。